为规范药品零售环节经营行为，某地药品监督管理部门对辖区内药品零售企业开展监督检查。检查发现（1）甲药品零售企业涉嫌从非法渠道购进药品，部分批号的阿卡波糖片不能提供购进发票，且经追测码查询，供货单位系某医疗机构：涉嫌违规经营米非司酮片。（2）乙药品零售企业屡次绕开计算机系统销售过期的盐酸二甲双胍缓释片、二甲双胍格列本脲胶囊等药品；计算机系统中有多条超数量销售含麻黄碱类复方制剂的销售记录，其中最多一次销售了50盒，企业留存了本次销售的处方。关于甲从非法渠道购进药品行为的说法，正确的是
A. 甲未从药品上市许可持有人处购进药品
B. 甲未对购进药品严格履行供货方合法性审查
C. 甲未履行扫码提供药品追溯信息职责
D. 甲宣称购进的阿卡波糖片由合法药品生产企业生产，销售该药品无过错

正确答案：B。甲未对购进药品严格履行供货方合法性审查

解析：本题考查的是药品上市许可持有人药品销售行为。为规范药品零售环节经营行为，某地药品监督管理部门对辖区内药品零售企业开展监督检查。检查发现（1）甲药品零售企业涉嫌从非法渠道购进药品，部分批号的阿卡波糖片不能提供购进发票，且经追测码查询，供货单位系某医疗机构：涉嫌违规经营米非司酮片。（2）乙药品零售企业屡次绕开计算机系统销售过期的盐酸二甲双胍缓释片、二甲双胍格列本脲胶囊等药品；计算机系统中有多条超数量销售含麻黄碱类复方制剂的销售记录，其中最多一次销售了50盒，企业留存了本次销售的处方。关于甲从非法渠道购进药品行为的说法，正确的是甲未对购进药品严格履行供货方合法性审查（B对）。药品上市许可持有人应当严格审核药品购进单位资质，按照其药品生产范围、经营范围或诊疗范围向其销售药品。甲药品零售企业涉嫌从非法渠道购进药品，部分批号的阿卡波糖片不能提供购进发票（D错），且经追测码查询（C错），供货单位系某医疗机构（A错）。